结构中含有异丁基的药物是
A. 阿司匹林
B. 布洛芬
C. 吲哚美辛
D. 双氯芬酸钠
E. 对乙酰氨基酚

正确答案：B。布洛芬